按照中国九分法计算烧伤面积，成人头、面、颈部占
A. 0.045
B. 0.09
C. 0.18
D. 0.36
E. 0.42

正确答案：B。0.09

解析：根据中国九分法计算烧伤面积，成人头、面、颈部占9%（B对）；双上肢为2x9%，故双上肢共占18%（C错）；躯干前后包括会阴部为3X9%，双下肢包括臀部为5x9%+1%=46%。